急性重型肝炎，最有诊断意义的临床表现
A. 黄疸迅速加深
B. 肝脏迅速缩小
C. 有明显出血倾向
D. 出现中枢神经系统症状
E. 出现腹水及肾功能不全

正确答案：D。出现中枢神经系统症状

解析：急性重型肝炎又称暴发性肝炎，其特点是起病急骤、发展迅速。早起以精神神经症状最突出，如性格改变、嗜睡、行为异常、意识障碍等，同时可有肝浊音界缩小，出血倾向明显，黄疸急剧加深。应重视昏迷前驱症状即中枢神经系统症状（D对）以便做出早期诊断，最有诊断意义。即使黄疸很轻，或尚未出现黄疸，具有以上症状亦应考虑急性重型肝炎。